关于拔牙时力的应用下列说法错误的是
A. 摇动力适用于扁根牙或多根牙
B. 摇动顺序应向阻力小的一侧进行
C. 扭转力适用于单个锥形根的牙
D. 扭转力应按牙根纵轴方向进行
E. 牵引力不应与摇动力及扭转力结全使用以防损伤

正确答案：E。牵引力不应与摇动力及扭转力结全使用以防损伤

解析：本题考查拔牙时力的应用。拔牙时的力主要有三种：摇动、扭转、牵引。牵引是使患牙自牙槽窝脱出必须、直接的力量，一般是使患牙脱位的最后步骤，适用于任何类型的牙牵引，应在牙有一定松动度后开始，应与摇动或扭转结合进行（E错，为本题的正确答案），在最终松动之前切记使用暴力牵拉，以免断根和对（牙合）牙损伤。通过缓慢反复的摇动，利用牙槽窝的弹性和让性，将牙槽窝逐步扩大，并撕断牙周膜，适用于扁根牙或多根牙（A对）；摇动应先向弹性大、阻力小（B对）、牙槽骨比较薄的一侧进行摇动，有利于牙槽窝的扩大。扭转主要适用于圆锥形的单根牙（C对），通过沿牙根纵轴方向作反复的旋转（D对）而撕裂牙周膜.扩大牙槽窝，所以多根牙、扁根牙、弯根牙不能进行扭转，否则会断根。